为双悬果，长2～4mm，表面灰黄色或灰褐色，果皮松脆，揉搓易脱落，种子细小。气香，味辛凉，有麻舌感的药材是
A. 蛇床子
B. 连翘
C. 栀子
D. 小茴香
E. 女贞子

正确答案：A。蛇床子

解析：本题考查的是蛇床子药材的性状鉴别。为双悬果，长2～4mm，表面灰黄色或灰褐色，果皮松脆，揉搓易脱落，种子细小。气香，味辛凉，有麻舌感的药材是蛇床子（A对）。蛇床子：【性状鉴别】药材为双悬果，呈椭圆形。表面灰黄色或灰褐色，顶端有2枚向外弯曲的柱基，基部偶有细梗。分果的背面有薄而突起的纵棱5条，接合面平坦，有2条棕色略突起的纵棱线。果皮松脆，揉搓易脱落，种子细小，灰棕色，显油性。气香，味辛凉，有麻舌感。连翘（B错）：【性状鉴别】药材呈长卵形至卵形，稍扁。表面有不规则纵皱纹和多数突起的小斑点，两面各有1条明显的纵沟。顶端锐尖，基部有小果梗或已脱落。青翘多不开裂，表面绿褐色，突起的灰白色小斑点较少；质硬；种子多数，黄绿色，细长，一侧有翅。老翘自顶端开裂或裂成两瓣，表面黄棕色或红棕色，内表面多为浅黄棕色，平滑，具一纵隔；质脆；种子棕色，多已脱落。气微香，味苦。栀子（C错）：【性状鉴别】药材呈长卵圆形或椭圆形。表面红黄色或棕红色，具6条翅状纵棱，棱间常有1条明显的纵脉纹，并有分枝。顶端残存萼片，基部稍尖，有残留果梗。果皮薄而脆，略有光泽；内表面色较浅，有光泽，具2～3条隆起的假隔膜。种子多数，扁卵圆形，集结成团，深红色或红黄色，表面密具细小疣状突起。气微，味微酸而苦。小茴香（D错）：【性状鉴别】药材为双悬果，呈圆柱形，有的稍弯曲。表面黄绿色或淡黄色，两端略尖，顶端残留有黄棕色突起的柱基，基部有时有细小的果梗。分果呈长椭圆形，背面有纵棱5条，接合面平坦而较宽。横切面略呈五边形，背面的四边约等长。有特异香气，味微甜、辛。女贞子（E错）：【性状鉴别】药材呈卵形、椭圆形或肾形。表面黑紫色或灰黑色，皱缩不平。基部有果梗痕或具宿萼及短梗。体轻。外果皮薄，中果皮较松软，易剥离，内果皮木质，黄棕色，具纵棱，破开后种子通常为1粒，肾形，紫黑色，油性。气微，味甘、微苦涩。